现在医学科学工作者通过获得大量特异DNA片段，结合适当的分析技术即可鉴定基因缺陷。当前临床或研究室获得大量特异DNA片段最流行的方法是
A. 化学合成
B. DNA合成仪合成
C. 从外周血细胞大量制备
D. 基因克隆
E. 聚合酶链反应

正确答案：E。聚合酶链反应

解析：当前临床或研究室获得大量特异DNA片段最流行的方法是聚合酶链反应（PCR）（E对）。PCR法以拟扩增的DNA分子为模板，以1对与模板互补的寡核苷酸片段为引物，在DNA聚合酶作用下，依半保留机制沿模板链延伸直至完成2条新链合成。重复这一过程，即可使目的DNA片段得到扩增。化学合成（A错）、DNA合成仪合成（B错）、基因克隆（D错）均可获得大量特异DNA片段，但非最流行的方法。外周血细胞中不能大量制备DNA片段（C错）。